镜下表现为增生的炎性肉芽组织充满龋洞，表面为炎性渗出物，深层有炎症细胞浸润。此为以下哪项的病理表现
A. 慢性溃疡性牙髓炎
B. 慢性闭锁性牙髓炎
C. 溃疡型牙髓息肉
D. 上皮型牙髓息肉
E. 急性牙髓炎

正确答案：C。溃疡型牙髓息肉

解析：本题考查牙髓息肉的病理表现。镜下表现为增生的炎性肉芽组织充满龋洞，表面为炎性渗出物，深层有炎症细胞浸润。此为溃疡型牙髓息肉（C对）的病理表现。溃疡型牙髓息肉的病理表现为：增生的炎性肉芽组织充填于龋洞中或突出于龋洞外，表面为炎性渗出物和坏死组织覆盖，深层为新生的毛细血管、成纤维细胞和散在的淋巴细胞、浆细胞、巨噬细胞和中性粒细胞等炎症细胞浸润。